感冒患者，恶寒发热轻微，但以脘腹冷痛，呕吐，腹泻为主症，舌苔薄，脉紧。其病机是
A. 寒邪伤及卫阳
B. 寒邪伤及太阴
C. 寒邪直中少阴
D. 寒邪直中脾胃
E. 寒邪伤及厥阴

正确答案：D。寒邪直中脾胃

解析：“感冒患者，恶寒发热轻微，但以脘腹冷痛，呕吐，腹泻为主症”符合寒邪直中脾胃，脾阳受损，可见脘腹冷痛、呕吐、腹泻等症的表现（D对）。